关于单端固定桥的描述，正确的是
A. 桥体与固位体之间一端为固定连接，另一端为活动连接
B. 受力主要有桥体承担，基牙不会受到损害
C. 桥体的一端必须与邻牙接触
D. 适用于缺牙间隙较大的牙列缺损修复
E. 又称悬臂梁单端桥

正确答案：E。又称悬臂梁单端桥

解析：单端固定桥又称悬臂梁单端桥，桥体只有一端有固位体与其固定相连接，桥体的另一端与邻牙接触。单端固定桥粘固在一端基牙上。这种设计增大了扭力矩，基牙极易倾斜、扭转而引起牙周组织创伤，故一般不能单独使用，只在缺牙间隙小时慎用，或用于复合固定桥的个别小间隙。个别后牙可以使用，例如游离端缺失牙齿，且缺失牙对（牙合）牙齿为活动义齿，这样的情况可以考虑使用单端固定桥。掌握“固定桥的组成和分类”知识点。